用口服葡萄糖耐量试验诊断糖尿病标准，其2小时血糖应
A. ≥11.1mmol/L
B. ≥7.1mmol/L
C. ≥10.1mmol/L
D. ≥7.9mmol/L
E. ≥12.1mmol/L

正确答案：A。≥11.1mmol/L

解析：当血糖高于正常范围而又未达到诊断糖尿病标准时，须进行口服葡萄糖耐量试验（OGTT）。OGTT2hPG＜7.7mmol/L为正常糖耐量；7.8～11.0mmol/L为糖耐量异常；≥11.1mmol/L应考虑糖尿病（A对）。